以下哪个不是新生儿期保健的原则
A. 保温
B. 清理呼吸道
C. 断脐
D. 预防感染
E. 睡眠

正确答案：E。睡眠

解析：本题考查新生儿期的保健原则。睡眠（E错，为本题正确答案）不属于新生儿的保健原则。新生儿期保健的原则：1.新生儿出生后随即要断脐（C对），断脐后还需护脐，脐部要保持清洁、干燥；2.娩出时，咽喉部的羊水不能完全排出，要及时清理呼吸道（B对），防止引起婴儿窒息；3.注意保温（A对）：由于新生儿刚脱离母体，不太适应外界环境，容易出现体温低的现象，应该注意保暖；4.预防感染（D对）：由于新生儿的免疫功能不完善，机体抵抗力低，因此预防新生儿感染一般比较重要。